牙尖交错（牙合）时，下前牙咬在上前牙的唇侧，或下颌后牙的颊尖咬在上颌后牙的颊侧称为
A. 反覆盖
B. 反（牙合）
C. 锁（牙合）
D. 反锁（牙合）
E. 对刃（牙合）

正确答案：B。反（牙合）

解析：牙尖交错（牙合）时，下前牙咬在上前牙的唇侧，或下颌后牙的颊尖咬在上颌后牙的颊侧，称为反（牙合）。下颌牙反盖着上颌牙，则称为反覆盖。掌握“牙尖交错（牙合）、前伸（牙合）及侧（牙合）”知识点。